男，44岁，因发热、胸痛伴心包摩擦音，曾用非激素类抗炎药。2周后，呼吸困难加重，心率110次/分，律齐，心音遥远，血压90/70mmHg。肝脏肿大，下肢浮肿。患者近2周出现的病情变化，提示
A. 肾功能不全
B. 心脏压塞
C. 右心功能不全
D. 肝硬化
E. 粘液性水肿

正确答案：B。心脏压塞

解析：患者中年男性，有发热胸痛症状并伴心包摩擦音，提示有急性心包炎；近2周来呼吸困难加重，心音遥远（心包积液常见体征），肝脏肿大，下肢浮肿（体循环淤血表现），提示患者由于急性心包炎发展为心脏压塞（B对）。肾功能不全（A错）患者多有少尿、消瘦、厌食、疲乏等症状，且多伴有血压增高表现。右心功能不全（C错）虽然也可导致肝脏肿大、下肢浮肿等体循环淤血表现，但一般不会出现心音遥远等心包积液体征。肝硬化（P406）（D错）患者常有严重肝功能减退和门静脉高压症，可出现食欲减退、营养不良、黄疸、大量腹水等症状。黏液性水肿（九版诊断学P15）（E错）是指由于组织间隙亲水物质增加而引起的一种特殊类型的水肿，常见于甲状腺功能减退的患者，也可见于少数甲亢患者。